患者男，60岁，14、25、32、45缺失，口内余牙情况良好，制作基托时，以下哪项不是基托做缓冲的目的
A. 防止有碍发音
B. 防止基托翘起
C. 防止压迫龈组织
D. 防止压痛
E. 防止压伤黏膜组织

正确答案：A。防止有碍发音

解析：本题考查局部义齿人工牙及基托。防止有碍发音（A错，为本题正确答案）不是基托做缓冲的目的。发音与基托的厚薄、光滑度及牙齿排列有关，跟缓冲没有关系。